人体内外环境的统一性，中医学称为
A. 辨证论治
B. 整体观念
C. 恒动观念
D. 阴阳互化

正确答案：B。整体观念

解析：本题考查整体观念的概念。人体内外环境的统一性，中医学称为整体观念（B对）。中医学理论体系的主要特点，一是整体观念，二是辨证论治。整体观念的概念：中医学认识人体自身以及人与自然环境、社会环境之间联系性和统一性的学术思想。辨证论治（A错）：辨证论治是中医学分析疾病、治疗疾病的基本思路，是中医学对疾病的一种独特的研究和处理方法。阴阳的相互转化（D错）：阴阳转化，是指在一定的条件下，阴或阳可以各自向其相反方向转化的质变形式，即由阴转阳、由阳转阴。阴阳相互转化的条件，一般都表现在事物变化的“物极”阶段。如果说“阴阳消长”是一个量变过程的话，则阴阳转化便是在量变基础上的质变。